药材产地加工的目的有
A. 除去杂质及非药用部位，保证药材的纯净度
B. 使药用部位尽快灭活，干燥或保鲜，防腐，保证药材质量
C. 降低或消除药材毒性或刺激性，保证用药安全
D. 有利于药材商品规格标准化
E. 有利于药材包装、运输与贮藏

正确答案：A、B、C、D、E。除去杂质及非药用部位，保证药材的纯净度；使药用部位尽快灭活，干燥或保鲜，防腐，保证药材质量；降低或消除药材毒性或刺激性，保证用药安全；有利于药材商品规格标准化；有利于药材包装、运输与贮藏

解析：本题考查的是中药材产地加工的目的。药材产地加工的目的有除去杂质及非药用部位，保证药材的纯净度（A对）、使要用部位尽快灭活，干燥或保鲜，防腐，保证药材质量（B对）、降低或消除药材毒性或刺激性，保证用药安全（C对）、有利于药材商品规格标准化（D对）与有利于药材包装、运输与贮藏（E对）。中药材产地加工的其目的：1.除去杂质及非药用部位，保证药材的纯净度。2.按《中国药典》规定进行加工或修制，使药材尽快灭活，干燥，保证药材质量。3.降低或消除药材的毒性或刺激性，保证用药安全。4.有利于药材商品规格标准化。5.有利于包装、运输与贮藏。